无雌激素、雄激素、肾上腺皮质激素样作用，代谢物没有雌激素活性，可用于黄体功能不足的先兆流产治疗的药物是
A. 地屈孕酮
B. 屈螺酮
C. 甲羟孕酮
D. 环丙孕酮
E. 左炔诺孕酮

正确答案：A。地屈孕酮

解析：本题考查地屈孕酮。无雌激素、雄激素、肾上腺皮质激素样作用，代谢物没有雌激素活性，可用于黄体功能不足的先兆流产治疗的药物是地屈孕酮（A对）。屈螺酮（B错）具有抗盐皮质激素和抗雄激素的作用。甲羟孕酮（C错）主要用于治疗肾癌、乳腺癌、子宫内膜癌、前列腺癌等病症。环丙孕酮（D错）的抗雄激素作用很强，也有孕激素活性，能抑制垂体促性腺激素的分泌，用于不孕症、先兆流产及习惯性流产、子宫内膜异位、功能性子宫出血、闭经、更年期综合征、骨质疏松、子宮内膜癌或肾癌的治疗。左炔诺孕酮（E错）可以抑制排卵并阻止孕卵着床。